治疗肺炎喘嗽肺脾气虚证，应首选
A. 人参五味子汤
B. 沙参麦门冬汤
C. 参附龙牡救逆汤
D. 四君子汤
E. 玉屏风散

正确答案：A。人参五味子汤

解析：肺炎喘嗽肺脾气虚证是由于病情迁延不愈，累及于脾所致，故治疗时应补肺健脾，益气化痰，首选人参五味子汤（A对）。沙参麦门冬汤（B错）其功用清养肺胃，生津润燥，适用于肺炎喘嗽之阴虚肺热证，百日咳恢复期之肺阴亏虚证。参附龙牡救逆汤（C错）其功用为益气回阳固脱，适用于肺炎喘嗽之心阳虚衰证。四君子汤（D错）其功用为益气健脾，适用于脾胃气虚证。玉屏风散（E错）其功用为益气固表止汗，适用于表虚自汗证。